降低肾素活性最明显的药物是
A. 氢氯噻嗪
B. 可乐定
C. 肼苯哒嗪
D. 普黎洛尔
E. 利血平

正确答案：D。普黎洛尔